关于心理应激的说法错误的是
A. 应激性生活事件是应激的原因
B. 个体面临或觉察到环境变化对机体有威胁或挑战时做出的适应性和应对性反应的过程
C. 心理应激是包括输入（原因）、中介、反应、应对的动态过程
D. 心理防御机制的应用可以从根本上消除解除焦虑
E. 反应则包括生理与心理两个方面

正确答案：D。心理防御机制的应用可以从根本上消除解除焦虑